目前评价疾病负担的最佳指标是
A. 伤残调整寿命年
B. 伤害死亡率
C. 伤害发生率
D. 潜在减寿年数
E. 粗死亡率

正确答案：A。伤残调整寿命年

解析：本题考查目前评价疾病负担的最佳指标。伤残调整寿命年（A对BCDE错）是指从发病（发生伤害）到死亡（或康复）所损失的全部健康生命年，是目前评价疾病负担的最佳指标。